逍遥散中配伍薄荷的用意是
A. 疏肝散热
B. 疏肝理气
C. 疏散风热
D. 清利头目
E. 利咽透疹

正确答案：A。疏肝散热

解析：逍遥散方含炙甘草、当归、茯苓、白芍药、白术、柴胡、煨生姜、薄荷，其中，柴胡疏肝解郁，为君药，当归、白芍养血柔肝，为臣药，白术、茯苓健脾，炙甘草益气，共为佐药，薄荷助柴胡舒肝，兼散肝郁所生之热（A对），亦为佐药，煨生姜（佐药）降逆和中、辛散达郁。